药用部位为干燥小叶的药材是
A. 艾叶
B. 枇杷叶
C. 番泻叶
D. 紫苏叶
E. 蓼大青叶

正确答案：C。番泻叶

解析：本题考查的是番泻叶药材的来源。药用部位为干燥小叶的药材是番泻叶（C对）。药用部位为完整而已长成的干燥叶，这类中药称叶类中药。一般为单叶，如枇杷叶（B错）；少数用复叶的小叶，如番泻叶；有时，尚带有部分嫩枝，如侧柏叶等。艾叶（A错）：【来源】为菊科植物艾的干燥叶。紫苏叶（D错）：【来源】为唇形科植物紫苏的干燥叶（或带嫩枝）。蓼大青叶（E错）：【来源】为为蓼科植物蓼蓝的干燥叶。